按照国家卫生标准，牛奶的比重要求是
A. 平均1.032
B. 1.000～1.028
C. 0.986～1.000
D. ≥1.028
E. ≤1.032

正确答案：A。平均1.032